对交感神经兴奋所致心律失常疗效较好的药物是
A. 胺碘酮
B. 普鲁卡因
C. 普萘洛尔
D. 利多卡因
E. 维拉帕米

正确答案：C。普萘洛尔

解析：本题考查普萘洛尔。对交感神经兴奋所致心律失常疗效较好的药物是普萘洛尔（C对）。普萘洛尔主要用于治疗室上性心律失常。对交感神经兴奋性增高、甲状腺功能亢进及嗜铬细胞瘤等引起的窦性心动过速效果好。胺碘酮（A错）为延长动作电位时程药可用于各种室上性和室性心律失常。常用于顽固性心律失常，静脉注射用于控制室性心动过速和心室颤动。普鲁卡因（B错）为局麻药。利多卡因（D错）为钠通道阻滞药，主要用于室性心律失常。治疗心脏手术、心导管术、急性心肌梗死及强心苷所致的室性期前收缩、室性心动过速及心室纤颤有效。维拉帕米（E错）为钙通道阻滞剂，治疗室上性和房室结折返心律失常效果好，是阵发性室上性心动过速的首选药。